儿童热能消耗包括
A. 基础代谢消耗的热能
B. 食物特殊动力作用
C. 生长发育消耗的热能
D. 体力活动消耗的热能
E. 以上都包括

正确答案：E。以上都包括